中医外科成为独立专科的年代是
A. 商代
B. 周代
C. 秦代
D. 汉代
E. 明代

正确答案：B。周代

解析：我国医事分科最早始于周代，开始把医生分为四类，其中疡医就是主治肿疡、溃疡、金创和折疡的外科专科医生，因而说中医外科成为独立专科的年代是周代（B对）。而周以前（A错）的文献只记载了一些外科疾病和治疗外科疾病的简单器械；秦（C错）、汉（D错）、明代（E错）则为中医外科由专科发展为学科作出了贡献。